薄荷具有的功效是
A. 透疹，利咽消肿
B. 透疹，利咽，清利头目
C. 透疹，明目退翳
D. 透疹，解肌清热
E. 透疹，清热解毒

正确答案：B。透疹，利咽，清利头目

解析：薄荷质轻上浮，辛香凉散，疏泄清利，入肺、肝经。既善散上焦风热而清利头目与咽喉，又能透发疹毒和疏肝。治风热诸疾最宜，治肝郁化热可投。功效疏散风热，清利头目，利咽，透疹，疏肝行气。（B对）。透疹，利咽消肿（A错）是牛蒡子的功效。透疹，明目退翳（C错）是蝉蜕的功效。透疹，解肌清热（D错）是葛根的功效。透疹，清热解毒（E错）是升麻的功效。